适宜作片剂崩解剂的辅料是
A. 微晶纤维素
B. 甘露醇
C. 羧甲基淀粉钠
D. 糊精
E. 羟丙纤维素

正确答案：C。羧甲基淀粉钠

解析：本题考查片剂的常用辅料。崩解剂系指促使片剂在胃肠液中迅速破裂成细小颗粒的辅料。常用的崩解剂有：干淀粉、羧甲基淀粉钠（CMS-Na）（C对）、低取代羟丙基纤维素、交联羧甲基纤维素钠（CCMC-Na）、交联聚维酮（PVPP）和泡腾崩解剂（碳酸氢钠和枸橼酸组成的混合物，也可以用柠檬酸、富马酸与碳酸钠、碳酸钾、碳酸氢钾）等。微晶纤维素（A错）、甘露醇（B错）、糊精（D错）为稀释剂。羟丙纤维素（E错）为黏合剂。